宫颈癌可能因
A. 淋病感染
B. 梅毒感染
C. 艾滋病病毒感染
D. 人乳头瘤病毒感染
E. 沙眼衣原体感染

正确答案：D。人乳头瘤病毒感染